血管内皮细胞损伤或激活引起DIC的机制是
A. 表达大量TF
B. 内皮损伤胶原暴露，促进血小板的聚集和释放反应
C. 抗凝物质如AT-III、TFPI生成减少
D. FXII与内皮下暴露的胶原接触并激活，启动内源性凝血系统
E. 以上均是

正确答案：E。以上均是

解析：缺氧、酸中毒、抗原－抗体复合物、严重感染、内毒素等原因，均可损伤血管内皮细胞，产生如下作用：①损伤的血管内皮细胞表达大量TF（A对），启动外源性凝血系统；②血管内皮细胞的抗凝作用降低。主要表现在：血栓调节蛋白－蛋白 C和抗凝物质如AT-III、TFPI生成减少（C对）；③血管内皮细胞产生组织型纤溶酶原激活物减少，PAI-1增多，使纤溶活性降低④血管内皮细胞损伤使一氧化氮、前列腺素、ADP 酶等产生减少，其抑制血小板黏附、聚集的功能降低，而且由于血管内皮细胞损伤，内皮损伤胶原暴露，促进血小板的聚集和释放反应（B对）⑤FXII与内皮下暴露的胶原接触并激活，启动内源性凝血系统（D对，E为本题正确答案），促进DIC的发生。